患者，男，67岁。原发性支气管肺癌，咳嗽，痰多，胸闷，纳差便溏，身热尿黄，舌质暗或有瘀斑，苔厚腻，脉滑数。其证型是
A. 气滞血瘀
B. 痰湿毒蕴
C. 阴虚毒热
D. 气阴两虚
E. 阴阳两虚

正确答案：B。痰湿毒蕴

解析：患者原发性支气管肺癌，痰热郁阻肺气，肺失清肃，肺气上逆故见咳嗽，痰多，胸闷；脾气亏虚故见纳差便溏；热邪煎灼津液故见身热尿黄；舌质暗或有瘀斑，苔厚腻，脉滑数均为痰湿毒蕴的的症状（B对）。气滞血瘀证（A错）的特点为咳嗽，咯痰，或痰血暗红，胸闷胀痛或刺痛，面青唇暗，肺中积块。阴虚毒热证（C错）的特点为咳嗽，无痰或少痰，或有痰中带血，甚则反复咯血，肺中积块，心烦，少寐，手足心热，或低热盗汗，或邪热炽盛，羁留不退，口渴，大便秘结。气阴两虚证（D错）的特点为咳嗽无力，有痰或无痰，或痰中带血，肺中积块，神疲乏力，时有心悸，汗出气短，口干，发热或午后潮热，手足心热，纳呆脘胀。阴阳两虚证（E错）的特点为咳喘气短，动则尤甚，咯痰色白，或夹血丝，血色暗淡，自汗盗汗，声嘶或失音，面浮肢肿，心慌，唇紫肢冷，形寒或见五更泄泻，口舌生糜，大肉尽脱。